下列哪组毒物能经皮肤吸收
A. 甲苯、四乙基铅、敌敌畏、金属汞
B. 敌白虫、四乙基铅、苯、三硝基甲苯
C. 敌白虫、乙醚、四乙基铅、苯
D. 甲苯、乙醚、氨、苯
E. 苯、三硝基甲苯、敌敌畏、金属汞

正确答案：A。甲苯、四乙基铅、敌敌畏、金属汞

解析：本题考查经皮肤吸收的毒物。大多数毒物如甲苯，二甲苯，三硝基甲苯这类苯的氨基和硝基化合物，敌敌畏敌百虫等有机磷农药，汞、四乙基铅都可经皮肤吸收（A对）。苯、乙醚、氨（BCDE错）却主要经过呼吸道吸收进入体内造成危害。